偶见药品不良反应发生率范围在
A. 发生率≥1/10
B. 1/100≤发生率≤1/10
C. 1/1000≤发生率≤1/100
D. 1/10000≤发生率≤1/1000
E. 发生率≤1/10000

正确答案：C。1/1000≤发生率≤1/100

解析：本题考查药品不良反应发生率。国际医学科学组织委员会推荐不良反应的发生率表示为：1.十分常见（≥10%）；2.常见（1%～10%，含1%）；3.偶见（0.1%～1%，含0.1%）（C对）；4.罕见（0.01%～0.1%，含0.01%）；5.十分罕见（＜0.01%）。